患者腹痛肠鸣，泻下粪便臭如败卵，但泻而不爽，脘腹胀满，舌苔白厚而腐，脉滑。治疗应首选
A. 保和丸
B. 藿香正气散
C. 葛根芩连汤
D. 参苓白术散
E. 龙胆泻肝汤

正确答案：A。保和丸

解析：患者以腹痛肠鸣，泻下粪便臭如败卵为主症，故诊断为泄泻。饮食不节，宿食内停，阻滞肠胃，传化失常，故腹痛肠鸣，脘腹胀满；宿食下注，则泻下粪便臭如败卵；泻后腐浊外泄，故腹痛减轻；舌苔白厚而腐，脉滑为宿食内停之象。故诊断为泄泻食滞肠胃证，方选保和丸（A对）。藿香正气散功能解表和中散寒，理气化湿，除满健脾，为治疗泄泻寒湿内盛证的选方（B错）。葛根芩连汤功能解表清里，升清止泻，为泄泻湿热伤中证的选方（C错）。参苓白术散功能补气健脾，渗湿合胃，为治疗泄泻脾胃虚弱证的选方（D错）。龙胆泻肝汤功能清理肝胆湿热，为胁痛肝胆湿热证的选方（E错）。